某砂轮工于冬季因右手手麻、手痛、夜间疼痛加剧、影响睡眠，便赴医院诊治。你认为如确诊是否为局部振动病的主要依据是
A. 检查是否出现白指、白手
B. 冷水试验
C. 指端甲皱微循环
D. 振动觉
E. 尿羟脯氨酸

正确答案：A。检查是否出现白指、白手

解析：本题考查局部振动病的症状。局部振动病又称手臂振动病，是指长期从事手传振动作业而引起的以手部末梢循环障碍、手臂神经功能障碍为主的疾病，并可引起手、臂骨关节、肌肉的损伤。其典型表现为振动性白指（A对BCDE错），其发作具有一过性特点，一般是在受冷后，患指出现麻、胀、痛，由远端向近端发展，界限分明。白指常见的部位是示指、中指和无名指的远端指节，严重者可累及近端指节，以至全手指变白。手部受冷尤其使全身受冷时容易发生白指，故冬季早晨上班途中或夜间主诉白指较多。